男性，17岁。诉牙齿出血、咀嚼无力1个月余。口腔检查：切牙和第一磨牙松动Ⅰ°，切牙唇侧移位，牙周袋5～6mm，第一磨牙牙周袋6mm，菌斑指数和牙龈指数1，探诊牙龈出血。初步诊断为
A. 成人牙周炎
B. 青少年牙周炎
C. 快速进展性牙周炎
D. 青春期龈炎
E. 青春前期牙周炎

正确答案：B。青少年牙周炎

解析：本题考查局限型侵袭性牙周炎的临床表现。患者男性，17岁，正处于青春期，牙齿出血、咀嚼无力，切牙和第一磨牙松动，切牙唇侧移位，菌斑量少，牙龈炎症轻微，但有深牙周袋形成，探诊易出血，患者的临床表现符合青少年牙周炎（B对）的临床病变特点。成人牙周炎（A错）主要是由局部因素引起的牙周支持组织的慢性炎症，发病年龄以35岁以后较为多见。快速进展性牙周炎（C错）是指在连续一段时间内病情进展迅速，破坏严重，疗效欠佳，发生于青春期到35岁之间的牙周炎，通常以年龄35岁以下和全口大多数牙的重度牙周破坏作为诊断标准。青春期龈炎（D错）表现为唇侧牙龈肿胀较明显，龈乳头常呈球状突起，探诊出血明显，龈沟可加深形成龈袋，但无真性牙周袋形成。青春前期牙周炎（E错）是侵袭乳牙的不常见的牙周疾病,常在乳牙萌出后很短时期内发生，多好发于4岁左右的儿童。